关于手术区的消毒和铺巾，哪种说法是不正确
A. 消毒应从中心开始，逐步向四周环绕涂布，感染创口相反
B. 与口腔相通的手术及多个手术可一并消毒
C. 孔巾铺置法适用于门诊小手术
D. 三角形铺巾法适用于口腔、鼻、唇及颊部手术
E. 四边形铺巾法适用于腮腺区、颌下区、面部及涉及多部位的大型手术

正确答案：B。与口腔相通的手术及多个手术可一并消毒

解析：本题考查手术区的消毒和铺巾。与口腔相通的手术及多个术区的手术应分别消毒（B错，为本题的正确答案），防止交叉感染。手术区的消毒应从术区中心开始，逐步向四周环绕涂布，但感染创口相反（A对），以保证术区的无菌。孔巾铺置法即将孔巾之孔部对准术区而将头面部遮盖，以巾钳或缚带固定，比较简单易操作，适用于门诊小手术（C对）。三角形手术野铺巾法即用3块无菌巾分别铺置，呈三角形遮盖术区周围皮肤，以巾钳固定，适用于口腔、鼻、唇及颊部手术（D对）。四边形手术野铺巾法即用4块无菌巾分别铺置，呈四角形遮盖术区周围皮肤，以巾钳或缝合法固定，适用于腮腺区、下颌下区、颈部及涉及多部位的大型手术（E对）。